左睾丸静脉通常注入
A. 左肾静脉
B. 下腔静脉
C. 脾静脉
D. 肝门静脉
E. 髂外静脉

正确答案：A。左肾静脉

解析：左睾丸静脉通常以直角注入左肾静脉（A对）。右睾丸静脉以锐角注入下腔静脉。